既开窍，又止痛的药是
A. 木香
B. 沉香
C. 青木香
D. 苏合香
E. 小茴香

正确答案：D。苏合香

解析：本题考查的是苏合香的功效。既开窍，又止痛的药是苏合香（D对）。苏合香：【功效】开窍辟秽，止痛。木香（A错）：【功效】行气止痛，健脾消食。沉香（B错）：【功效】行气止痛，温中止呕，温肾纳气。青木香（C错）：【功效】行气止痛，解毒消肿。小茴香（E错）：【功效】散寒止痛，理气和胃。